女，31岁。1周前出现颈部痛和低热未加注意，症状加重后来门诊检查，发现甲状腺明显肿大，触之疼痛，有结节先考虑的是
A. Graves病
B. 慢性淋巴细胞性甲状腺炎
C. 亚急性甲状腺炎
D. 甲状腺肿
E. 甲状腺癌

正确答案：C。亚急性甲状腺炎

解析：患者青年女性，1周前出院颈部痛和低热（提示感染症状）未加注意，症状加重后来门诊检查，发现甲状腺明显肿大，触之疼痛，有结节（亚急性甲状腺炎明显临床特点）。综合患者病史、症状，先考虑的是亚急性甲状腺炎（C对）。Graves病（A错）患者呈弥漫性对称性肿大，质软，吞咽时上下移动；患者怕热，多汗，皮肤、手掌、面、颈、腋下皮肤红润多汗。常有低热，发生危象时可出现高热，患者常有心动过速、心悸、食欲亢进，但体重下降，疲乏无力。慢性淋巴细胞性甲状腺炎（B错）患者甲状腺多为双侧对称性、弥漫性肿大，峡部及锥状叶常同时增大，也可单侧性肿大。触诊时，甲状腺质地韧，表面光滑或细沙粒状，也可呈大小不等的结节状，一般与周围组织无黏连，吞咽运动时可上下移动。甲状腺肿（D错）早期甲状腺呈弥漫性增大、质软、对称。甲状腺癌（E错）典型的临床表现为甲状腺内发现肿块，质地硬而固定、表面不平。早期无明显症状，晚期可产生声音嘶哑、呼吸、吞咽困难和交感神经受压引起Horner综合征及侵犯颈丛出现耳、枕、肩等处疼痛和局部淋巴结及远处器官转移等表现。